患者女性，33岁，劳累后心悸气促加重7年。检查：二尖瓣面容，第一心音亢进，心尖部可闻及Ⅲ级隆隆样舒张期杂音，有开瓣音，P₂＞A₂，心律规则，本次因为气促不能平卧伴咯血入院。下列最合适的治疗方法是
A. 吸氧
B. 西地兰静脉注射
C. 镇咳剂
D. 速尿静脉注射
E. 止血剂

正确答案：D。速尿静脉注射

解析：青年女性患者，劳累后心悸气促7年，二尖瓣面容，第一心音亢进，心尖部可闻及Ⅲ级隆隆样舒张期杂音（提示二尖瓣狭窄），本次因为气促不能平卧伴咯血（提示心功能不全并咯血），治疗宜速尿静脉注射，减轻心脏负荷（D对）。此为二尖瓣狭窄患者，病史7年，出现气促不能平卧伴咯血的症状，可能出现了急性肺水肿的情况，单纯吸氧并不能改善患者缺氧（A错），并且不宜使用正性肌力药，西地兰为正性肌力药，故不宜使用（B错），急性肺水肿导致的咯血不宜使用止血剂及镇咳药治疗（CE错）。